与有机磷中毒无关的症状是
A. 肌肉颤动
B. 多汗
C. 瞳孔缩小
D. 呕吐物有酸酵味
E. 唾液多

正确答案：D。呕吐物有酸酵味